下列叙述中不属于合理用药临床基础的是
A. 根据患者的病情检查做出正确诊断
B. 充分了解患者疾病的病生理状况
C. 制定正确的药物治疗方案和目标
D. 药物的毒、副作用最小或无不良反应
E. 正确实施药物治疗而获得预期效果

正确答案：D。药物的毒、副作用最小或无不良反应